上皮不全角化，棘层增生，基底细胞液化变性，形成上皮下疱的是以上哪种疾病的病理表现
A. 慢性盘状红斑狼疮
B. 良性黏膜类天疱疮
C. 扁平苔藓
D. 白斑
E. 红斑

正确答案：C。扁平苔藓

解析：本题考查口腔扁平苔藓与慢性盘状红斑狼疮。扁平苔藓（C对）在黏膜的白色条纹处上皮为不全角化层，一般棘层增生较多，基底细胞层液化、变性，因此基底细胞液化明显者可形成上皮下疱。